属于胃溶型包衣材料的是
A. 羟丙基纤维素
B. 甲基纤维素
C. 醋酸纤维素
D. 微晶纤维素
E. 邻苯二甲醋酸纤维素

正确答案：A。羟丙基纤维素

解析：本题考查片剂的包衣。羟丙基纤维素（A对）是胃溶型包衣材料；甲基纤维素（B错）为黏合剂；醋酸纤维素（C错）为不溶型包衣材料；微晶纤维素（D错）为稀释剂；邻苯二甲醋酸纤维素（E错）为肠溶型包衣材料。